语言发展的关键期是
A. 0～1岁
B. 1～3岁
C. 3～6岁
D. 1～7岁
E. 7岁前

正确答案：B。1～3岁